生后2月时应接种的疫苗是
A. 乙肝疫苗
B. 流感疫苗
C. 麻疹疫苗
D. 脊髓灰质炎疫苗
E. 白百破疫苗

正确答案：D。脊髓灰质炎疫苗

解析：根据我国卫生部规定的儿童计划免疫程序，儿童2个月、3个月和4个月时应注射脊髓灰质炎三价混合疫苗（D对）。出生时和1个月时注射乙肝疫苗（A错）。3个月、4个月和5个月时应注射百白破混合制剂（E错）。8个月时应注射麻疹疫苗（C错）。